未病先防的原则和方法有
A. 重视精神调养
B. 加强身体锻炼
C. 进行人工免疫
D. 控制疾病的传变
E. 避免病邪的侵害

正确答案：A、B、C、E。重视精神调养；加强身体锻炼；进行人工免疫；避免病邪的侵害

解析：本题考查的是未病先防的原则和方法。未病先防的原则和方法有重视精神调养（A对）、加强身体锻炼（B对）、进行人工免疫（C对）与避免病邪的侵害（E对）。未病先防的原则和方法：未病先防，即是在疾病发生之前，做好各种预防工作，以防止疾病的发生。疾病的发生，关系到邪正两个方面的因素。邪气是导致疾病发生的重要条件，而正气不足是疾病发生的内在原因，外邪通过内因而起作用。因此，未病先防，包括以下两个方面的原则和方法。1.扶助正气，提高抗病能力：增强体质，是提高正气抗邪能力的关键。（1）重视精神调养。（2）加强身体锻炼。（3）注意生活起居。（4）人工免疫。2.消灭病邪，防止邪气侵害：邪气是导致疾病发生的重要条件，注意避免病邪的侵害，即要谨慎躲避外邪的侵害。（1）药物杀灭。（2）讲究卫生。（3）避免病邪侵害。（4）防范各种外伤。控制疾病的传变（D错）属于既病防变的原则。既病防变，指在疾病发生之后，早期诊断，早期治疗，见微知著，防微杜渐，以防止疾病的发展和传变。既病防变的基本原则：1.早期诊治；2.控制疾病的传变。